以下哪项不属于医学道德教育的方法
A. 案例讨论，以理导人
B. 积极疏导、以情动人
C. 多加开导，以理服人
D. 典型引导，以形感人
E. 舆论扬抑，以境育人

正确答案：C。多加开导，以理服人